既是医德修养的一种方法，又是一种医德境界的是
A. 社会舆论
B. 内心信念
C. 慎独
D. 传统习俗
E. 以上都不是

正确答案：C。慎独

解析：医德中的“慎独”是指医务人员在单独工作、无人监督时，仍能坚持医德信念，履行医德原则和规范，不做违背医德的事情。“慎独”既是一种医德修养方法，也是一种高尚的医德境界（C对E错）。社会舆论是指公众对某种社会现象、事件或行为的看法和态度。社会舆论是社会道德评价的主要方式，是一种精神力量，对于敦促医务人员履行医德义务具有特殊的作用（A错）。医务人员的内心信念是指发自内心地对医德原则、规范和理想的正确性和崇高性的笃信，以及由此而产生的实现医德义务的强烈责任感。它通过道德良心发挥自律作用，能促进医务人员自觉地进行善恶评价和行为选择（B错）。传统习俗指人们在长期社会生活中逐步形成和沿袭下来的一种稳定的、习以为常的行为倾向（D错）。